胎儿期保健的原则是
A. 避免不利因素的影响
B. 保证有利因素的影响
C. 保证有利因素的影响、避免不利因素的影响
D. 可适当地使用一些药物
E. 由于胎盘的屏障作用不会感染疾病

正确答案：C。保证有利因素的影响、避免不利因素的影响

解析：本题考查胎儿期的保健原则。胎儿期的保健原则： 1.对胎儿保证有利因素的影响、避免不利因素的影响（C对AB错）；保证孕母有足够的营养，忌烟酒。2.慎用药物，最好不用（D错）、合理安排孕妇的生活和工作。3.注意孕期卫生，定期产前检查。胎盘屏障只免除部分细菌、病毒感染给胎儿的风险，并非所有病毒均可以屏蔽（E错）。